女，50岁。甲状腺多发结节3年。颈部超声提示：甲状腺双侧叶多发囊性、实性结节。实验室检查：T3、T4、TSH正常。在随访过程中，手术治疗指征不包括
A. 甲状腺结节増大伴憋气
B. 甲状腺结节的数量增加
C. 出现甲状腺功能亢进
D. 出现胸骨后甲状腺肿
E. 结节边界不清并细小钙化

正确答案：B。甲状腺结节的数量增加

解析：中老年女性，甲状腺多发结节3年，超声提示：甲状腺双侧叶多发囊性、实性结节。T3、T4、TSH正常（单纯性甲状腺肿的临床表现）。综合患者的病史、临床症状、影像学检查、实验室检查，该患者诊断考虑为单纯性甲状腺肿。单纯性甲状腺肿有以下情况时，应及时施行甲状腺手术：①因气管、食管或喉返神经受压引起临床症状者（A对）;②胸骨后甲状腺肿（D对）；③巨大甲状腺肿影响生活和工作者；④结节性甲状腺肿继发功能亢进者（C对）；⑤结节性甲状腺肿疑有恶变者（E对）。综上所述，甲状腺结节的数量增加（B错，为本题正确答案）不是手术指征。